慢性牙周炎患者的主诉症状通常为
A. 牙齿松动
B. 咀嚼无力
C. 咀嚼疼痛
D. 牙周溢脓
E. 以上均可能

正确答案：E。以上均可能

解析：牙周炎的主要症状是牙龈的炎症和出血、牙周袋的形成、牙槽骨吸收、牙松动和移位。无论是哪种类型的牙周炎都会有上述主诉症状。掌握“慢性牙周炎的病因，表现诊断及预后”知识点。